第一产程活跃期的减速期是指宫口扩张
A. 8～10cm
B. 3～10cm
C. 7～10cm
D. 5～10cm
E. 9～10cm

正确答案：E。9～10cm

解析：第一产程活跃期的减速期是指宫口扩张9～10cm（E对）。